患者，女，68岁。左下牙龈一菜花样溃疡，溃疡约3cm×2cm大小，下唇无麻木，活检诊为“鳞癌Ⅰ级”。下颌部未及明显肿大淋巴结。根据患者的症状，该患者的T分类表现是
A. T0
B. Tis
C. T1
D. T2
E. T3

正确答案：D。T2

解析：该患者肿物大小约3cm×2cm。T2：肿瘤最大直径＞2cm，≤4cm。掌握“鳞状细胞癌概述及舌癌、牙龈癌”知识点。